患者人工流产术后14天，仍阴道流血较多，伴下腹疼痛，体温38.5℃。双合诊子宫略大，呈球形，压痛明显。应考虑诊断是
A. 吸宫不全
B. 吸宫不全并发感染
C. 漏吸
D. 输卵管妊娠
E. 人工流产综合征

正确答案：B。吸宫不全并发感染

解析：该患者人工流产术后14天，仍阴道流血较多（手术后阴道流血时间长，血量多或流血停止后再现多量流血，应考虑为吸宫不全），伴下腹疼痛，体温38.5℃（体温升高，说明存在感染）。双合诊子宫略大，呈球形，压痛明显，应考虑为吸宫不全并发感染（B对A错）。漏吸（C错）是指行人工流产术未吸出胚胎及绒毛而导致继续妊娠或胚胎停止发育，术毕吸刮出物肉眼常不见绒毛。人工流产综合反应（E错）指手术时疼痛或局部刺激，使受术者在术中或术毕出现恶心呕吐、心动过缓、心律不齐、面色苍白等迷走神经兴奋症状。输卵管妊娠（P53）（D错）早期常无特殊的临床表现，晚期发生破裂时，突感一侧下腹部撕裂样疼痛，伴恶心呕吐，常有不规则阴道流血，妇检子宫大小与停经月份基本相符。